有关角膜的描述何者不正确
A. 占外膜的前1／6
B. 无色透明
C. 曲度较大，有屈光作用
D. 有毛细淋巴管但无毛细血管
E. 有丰富的感觉神经末梢

正确答案：D。有毛细淋巴管但无毛细血管

解析：角膜占外膜（即眼球纤维膜）的前1/6（A对），无色透明（B对），富有弹性，无血管但有丰富的感觉神经末梢（E对），且曲度较大，有屈光作用（C对，故D为本题正确答案）。